下列关于维生素E叙述正确的是
A. 1日量大于600mg可引起恶心、呕吐、胃痉挛
B. 头痛、眼花、烦躁、心律失常、浮肿和神经衰弱
C. 全身不适、发热、颅内压增高、毛发干枯、皮肤瘙痒、食欲缺乏
D. 低热、烦躁、惊厥、厌食、体重下降、肝脏肿大、肾脏损害、骨骼硬化等
E. 400～800mg/d可引起视力模糊、乳腺肿大、腹泻、头晕、流感样综合症

正确答案：E。400～800mg/d可引起视力模糊、乳腺肿大、腹泻、头晕、流感样综合症

解析：本题考查维生素E。维生素E能促进生殖力，提高生育能力，预防流产。大量服用维生素会引起很多不良反应：服用维生素E（400～800mg/d）可引起视物模糊、乳腺肿大、类流感样综合征、胃痉挛、疲乏、软弱（E对）；长期超量服用（＞800mg/d），对维生素缺乏者可引起出血倾向，并有出现血栓危险，其中较严重的有血栓性静脉炎或肺栓塞。维生素D能促进小肠对钙的吸收，用于预防和治疗维生素D缺乏引起的佝偻病，长期使用引起低热、烦躁哭闹、惊厥、厌食、体重下降、肝脏肿大、肾脏损害、骨硬化等（D错）。维生素C可用于防治坏血病，大量应用（每日用量1g以上）可引起腹泻、皮肤红而亮、头痛、尿频；每日用量600mg以上时引起恶心、呕吐、胃痉挛（A错）。维生素B₁长期大量使用可出现头痛、眼花、烦躁、心律失常、浮肿和神经衰弱等严重神经感觉异常（B错）。维生素A用于预防夜盲症。长期大量服用可引起慢性中毒，出现疲乏、软弱、全身不适、发热、贫血等；急性中毒可见异常激动、嗜睡、复视、颅内压增高等（C错）。